疾病都必然并且可以在器官、细胞或分子上找到可以测量的形态学或化学改变，都可以确定出生物的或理化的特定原因，都应该能找到治疗手段，指的是哪种的医学模式思想
A. 神灵主义医学模式
B. 自然哲学的医学模式
C. 机械论的医学模式
D. 生物医学模式
E. 生物-心理-社会医学模式

正确答案：D。生物医学模式